根据《中华人民共和国药品管理法》，由国家药品监督管理部门、国务院卫生行政部门共同制定的是
A. 药物临床试验机构资格认定办法
B. 中药品种保护制度
C. 地区性民间习用药材管理办法
D. 首次在中国销售的药品的检验费收缴办法
E. 首次在中国销售的药品的检验费项目

正确答案：A。药物临床试验机构资格认定办法

解析：本题考查药物临床试验机构资格认定办法的制定机构。根据《中华人民共和国药品管理法》，由国家药品监督管理部门、国务院卫生行政部门共同制定的是药物临床试验机构资格认定办法（A对）。开展临床试验，应当具备相应条件的临床试验机构进行。药物临床试验机构实行备案管理，具体办法由国务院药品监督管理部门、国务院卫生健康主管部门共同制定。中药品种保护制度（B错）由国务院制定。地区性民间习用药材管理办法（C错）由国家药品监督管理部门会同国家中医药管理部门制定。首次在中国销售的药品的检验费收缴办法（D错）由国务院财政部门会同国家药品监督管理部门制定。